根据《药品经营质量管理规范实施细则》，关于药品验收、储存与养护的说法，错误的是
A. 药品退货记录应保存3年
B. 药品批发企业的库房相对湿度应保存在45%～75%
C. 企业对近效期药品应按季度填报效期报表
D. 中药材和中药饮片应有包装，并附有质量合格的标志
E. 药品批发企业仓库中阴凉库的温度不得高于20℃

正确答案：C。企业对近效期药品应按季度填报效期报表

解析：本题考查《药品经营质量管理规范实施细则》。根据《药品经营质量管理规范实施细则》，关于药品验收、储存与养护的说法，错误的是企业对近效期药品应按季度填报效期报表（C错，为本题正确答案）。企业对近效期药品应按月填报效期报表。退货记录应保存3年（A对）。药品批发和零售连锁企业应根据所经营药品的储存要求，设置不同温、湿度条件的仓库。其中冷库温度为2～10℃；阴凉库温度不高于20℃（E对）；常温库温度为0～30℃；各库房相对湿度应保持在45～75%之间（B对）。中药材和中药饮片应有包装，并附有质量合格的标志（D对）。每件包装上，中药材标明品名、产地、供货单位；中药饮片标明品名、生产企业、生产日期等。实施文号管理的中药材和中药饮片，在包装上还应标明批准文号。